如果一个国家人口的出生率和死亡率都非常高，平均期望寿命较短，则其人口金字塔是
A. 增长型
B. 缩小型
C. 增大型
D. 稳定型
E. 缩减型

正确答案：A。增长型

解析：本题考查人口金字塔的类型。如果一个国家人口的出生率和死亡率都非常高，平均期望寿命较短，则其人口金字塔是增长型（A对BCDE错）。